患者阻塞性睡眠呼吸暂停综合征（OSAS）手术治疗的目的在于
A. 减轻和消除气道阻塞，防止气道软组织塌陷
B. 消除气管阻塞
C. 减轻和防止气管软组织塌陷
D. 减轻和消除软组织阻塞
E. 消除气管和软组织阻塞

正确答案：A。减轻和消除气道阻塞，防止气道软组织塌陷

解析：本题考查阻塞性睡眠呼吸暂停综合征手术治疗的目的。阻塞性睡眠呼吸暂停低通气综合征是由于上气道解剖上的狭窄和呼吸控制功能失调而造成，应该对症治疗，消除病因，可通过手术来减轻和消除气道阻塞，防止气道软组织塌陷（A对）。若只消除气道阻塞，气管软组织塌陷可再次引起OSAHS（B错）。在减轻和防止气管软组织塌陷的同时，还要消除气道阻塞（C错），双管齐下，才能完全治愈。同理，减轻和消除软组织阻塞（D错）、消除气管和软组织阻塞（E错）内容不全，为错误答案。